某男，53岁，患头痛多年，3天前因受情志刺激而加重。现头晕目眩，口干口苦，心烦易怒，夜寐不宁。舌红苔薄黄，脉弦有力。治宜选用的方剂是
A. 芎菊上清丸
B. 川芎茶调散
C. 通窍活血汤
D. 羚角钩藤汤
E. 杞菊地黄丸

正确答案：D。羚角钩藤汤

解析：本题考查头痛之肝阳头痛的方剂应用。患者为头痛之肝阳头痛，治宜选用的方剂是羚角钩藤汤（D对）。头痛之肝阳头痛【症状】头昏胀痛，两侧为重，心烦易怒，夜寐不宁，口苦面红，或兼胁痛。舌红苔黄，脉弦数。【方剂应用】基础方剂羚角钩藤汤。头痛之风热头痛【症状】头痛而胀，甚则头痛如裂，发热或恶风，口渴欲饮，面红目赤，或便秘溲黄。舌尖红，苔黄，脉浮数。【中成药应用】常用中成药芎菊上清丸（A错）。头痛之风寒头痛【症状】头痛时作，痛连项背，常有拘急收紧感，伴恶风畏寒，受风尤剧，口不渴。舌苔薄白，脉浮紧。【方剂应用】基础方剂川芎茶调散（B错）。头痛之瘀血头痛【症状】头痛经久不愈，痛处固定不移，痛如锥刺，或有头部外伤史。舌紫暗，或有瘀斑，瘀点，苔薄白，脉细或细涩。【方剂应用】基础方剂通窍活血汤（C错）。杞菊地黄丸（E错），滋阴药，适合肝肾阴虚证，临床可见眩晕耳鸣，视物减退、眼睛怕光，迎风流泪，健忘，腰膝酸软，盗汗，遗精，口舌咽干。